急性心肌梗死最常导致
A. 二尖瓣狭窄
B. 二尖瓣关闭不全
C. 主动脉瓣狭窄
D. 主动脉瓣关闭不全
E. 肺动脉瓣狭窄

正确答案：B。二尖瓣关闭不全

解析：急性心肌梗死时，会并发乳头肌功能失调或断裂，总发生率可高达50%，二尖瓣乳头肌因缺血、坏死等使收缩功能发生障碍，造成不同程度的二尖瓣脱垂或关闭不全（B对）。